药材总包件数在5～99件的，取样原则是
A. 随机抽5件取样
B. 按1%比例取样
C. 按5%比例取样
D. 按8%比例取样
E. 逐件取样

正确答案：A。随机抽5件取样